下列哪项不是学校卫生监督员应具备的职业素质
A. 忠实履行职责，严格执法
B. 具备丰富全面的业务知识
C. 有良好的操作技能和社会协调能力
D. 执法时不出示证件
E. 对查阅和搜集到的资料保密

正确答案：D。执法时不出示证件